证见四肢厥逆，恶寒蜷卧，呕吐不渴，腹痛下利，神衰欲寐，舌苔白滑，脉微细者，治疗应选用
A. 当归四逆汤
B. 通脉四逆汤
C. 四逆汤
D. 四逆散
E. 右归丸

正确答案：C。四逆汤

解析：本证系由少阴心肾阳衰，阴寒内盛所致。阳气不能温煦周身四末，则四肢厥逆、恶寒蜷卧；无力鼓动血行，则脉微细。若心阳衰微，神失所养，则神衰欲寐；肾阳衰微，不能暖脾，升降失调，则腹痛吐利；舌苔白滑，口中不渴，亦为阴寒内盛之象。此阳衰寒盛之证，非纯阳大辛大热之品，不足以破阴寒，回阳气，救厥逆，法当回阳破阴救逆。用回阳救逆之四逆汤治疗。（C对）。当归四逆汤（A错）的功用为温经散寒，养血通脉，主治血虚寒厥证。通脉四逆汤（B错）的功用为破阴回阳，通达内外，主治少阴病，阴盛格阳证。四逆散（D错）的功用为透邪解郁，疏肝理脾，主治阳郁厥逆证；肝脾不和证。右归丸（E错）的功用为温补肾阳，填精益髓，主治肾阳不足，命门火衰证。